佝偻病性手足搐搦症在幼儿及儿童多见的典型表现是
A. 惊厥
B. 手足搐搦
C. 喉痉挛
D. 枕秃
E. 肋骨串珠

正确答案：B。手足搐搦

解析：佝偻病性手足搐搦症是由于维生素D缺少而甲状旁腺又不能代偿，以致血中钙离子降低，神经肌肉兴奋性增高，出现惊厥（A错）、手足搐搦或喉痉挛（C错）等症状。小婴儿主要表现为全身惊厥、喉痉挛，幼儿及儿童多表现手足搐搦（B对）。枕秃（D错）和肋骨串珠（E错）属于维生素D缺乏性佝偻病的临床表现。